肢端肥大常见的面容
A. 苦笑面容
B. 粘液性水肿面容
C. 满月脸
D. 惊恐面容
E. 丑陋面容

正确答案：E。丑陋面容

解析：肢端肥大常见的面容是丑陋面容（E对），表现为颜面皮肤及软组织增厚，额部有深皱褶，皮肤线纹减少。鼻肥大，唇厚舌大。苦笑面容（A错）常见于破伤风病人。黏液性水肿面容（B错）常见于甲状腺功能减退的病人。满月脸（C错）见于长期使用糖皮质激素的病人或库欣综合征病人。惊恐面容（D错）常见于甲状腺功能亢进病人。